男，45岁。因反复咳嗽一个月到社区卫生服务中心就诊。医生与其交谈中得知该患者已经吸烟20多年，3年前曾经尝试戒烟一个月并得到家人的支持和鼓励。但后来患者由于听说戒烟会生病等传闻而不再考虑戒烟。根据行为改变的阶段模式，目前该患者处于
A. 维持阶段
B. 行动阶段
C. 无打算阶段
D. 打算阶段
E. 准备阶段

正确答案：C。无打算阶段

解析：患者不再考虑戒烟，所以是无打算阶段（C对）。行为改变的阶段模式认为人的行为变化通常需要经过5个阶段（即维持阶段、行动阶段、无打算阶段、打算阶段和准备阶段）。打算阶段（D错）打算在未来采取行为，改变疾病危险行为。处于准备阶段（E错）一般在为自己即将采取的行为做准备，如参加一些有关课程或购买需要的资料。行动阶段（B错）是指行为者正在采取相应的行为。行为维持阶段（A错）是指患者已经完成了自己的改变目标，本题中应是患者已经完成戒烟。